糖尿病患者宜少食用的食物成分是
A. 直链淀粉
B. 多糖
C. 精制糖
D. 可溶性膳食纤维
E. 不溶性膳食纤维

正确答案：C。精制糖